VitD代谢障碍
A. 低钙血症
B. 低磷血症
C. 两者均有
D. 两者均无
E. 无

正确答案：C。两者均有

解析：维生素D可促进钙磷在肠的吸收，VitD代谢障碍，钙磷吸收减少，引起低钙血症（A对）和低磷血症（B对，故C为本题正确答案）。